患者眼睑浮肿，继则四肢及全身皆肿，来势迅速，伴有恶寒发热，小便不利，舌苔薄白，脉浮紧。其证候是
A. 风水泛滥
B. 湿毒浸淫
C. 水湿浸渍
D. 湿热壅盛
E. 脾阳虚衰

正确答案：A。风水泛滥

解析：本病例以水肿为主症，故诊断水肿；风邪袭表，肺失宣降，不能通调水道，下属膀胱，故恶寒发热，小便不利，全身皆肿；风为阳邪，其性轻扬，风水相搏，推波助澜，故眼睑浮肿，随即遍及全身；舌苔薄白，脉浮紧，为风寒之象，故其证候为风水相搏证（A对）。水肿之湿毒浸淫证，其临床表现为眼睑浮肿，延及全身，皮肤光亮，尿少色赤，身发疮痍，甚则溃烂，恶风发热，舌质红，苔薄黄，脉浮数或滑数，本病例特点与之不符(B错)。水肿之水湿浸渍证，其临床表现为全身水肿，下肢明显，按之没指，小便短少，身体困重，胸闷腹胀，纳呆，泛恶，苔白腻，脉沉缓，起病较缓，病程较长，本病例特点与之不符（C错）。水肿之湿热壅盛证，其临床表现为遍体浮肿，皮肤绷急光亮，胸脘痞闷，烦热口渴，或口苦口粘，小便短赤，或大便干结，舌红，苔黄腻，脉滑数或沉数，本病例特点与之不符（D错）。水肿之脾阳虚衰证，其临床表现为身肿日久，腰以下为甚，按之凹陷不易恢复，脘腹胀闷，纳减便溏，面色不华，神倦乏力，四肢倦怠，小便短少，舌质淡，苔白腻或白滑，脉沉缓或沉弱，本病例特点与之不符（E错）。